VE含量测定方法为
A. 碘量法
B. 非水溶液滴定法
C. 高效液相色谱法
D. 毛细管电泳法
E. 气相色谱法

正确答案：E。气相色谱法

解析：本题考查维生素E的含量测定方法。维生素E及其制剂的含量测定采用气相色谱法（E对），该法专属性强，简便快速。高效液相色谱法（C错）用于维生素K₁的含量测定。